中国药典检查药物中的残留有机溶剂检查采用的方法是
A. 干燥失重测定法
B. 比色法
C. 高效液相色谱法
D. 薄层色谱法
E. 气相色谱法

正确答案：E。气相色谱法

解析：本题考查气相色谱法。中国药典检查药物中的残留有机溶剂检查采用的方法是气相色谱法（E对）。气相色谱法主要用于具有挥发性或其衍生物具挥发性的药物及其相关物质的分析，在中国药典中被广泛用于残留溶剂测定法。干燥失重测定法（A错）系指药物在规定的条件下，经干燥至恒重后所减失的重量，通常以百分率表示。干燥失重检查法主要控制药物中的水分及挥发性物质如乙醇等。比色法（B错）是通过比较或测量有色物质溶液颜色深度来确定待测组分含量的方法。高效液相色谱法（HPLC）（C错）系采用高压输液泵将规定的流动相泵入装有填充剂（表面键合有固定相的载体）的色谱柱，对供试品进行分离测定的色谱方法。本法是药物制剂尤其是复方制剂含量测定的首选方法。薄层色谱法（TLC）（D错）系将适宜的固定相涂布于玻璃板、塑料或铝基片上，成一均匀薄层。待点样、展开后，根据比移值（Rf）与适宜的对照物按同法所得的色谱图的比移值（Rf）作对比，用以进行药品的鉴别、杂质检查或含量测定的方法。